HIV与感染细胞膜上CD4分子结合的病毒刺突是
A. gp120
B. gp41
C. P24
D. P17
E. gp160

正确答案：A。gp120